某男，60岁。患慢性前列腺炎，症见小便频急、尿后余沥不尽、尿道灼热、会阴部疼痛。证属湿热蕴结兼瘀血，宜选用的中成药是
A. 三金片
B. 癃闭舒胶囊
C. 癃清片
D. 八正合剂
E. 肾炎四味片

正确答案：C。癃清片

解析：本题考查癃清片的主治。证属湿热蕴结兼瘀血，宜选用的中成药是癃清片（C对）。癃清片【主治】下焦湿热所致的热淋，症见尿频、尿急、尿痛、腰痛、小腹坠胀。亦用于慢性前列腺炎之湿热蕴结兼瘀血证，症见小便频急，尿后余沥不尽，尿道灼热，会阴、少腹、腰骶部疼痛或不适等。三金片（A错）【主治】下焦湿热所致的热淋，症见小便短赤、淋沥涩痛、尿急频数；急性肾盂肾炎、慢性肾盂肾炎、膀胱炎、尿路感染见上述证候者；慢性非细菌性前列腺炎肾虚湿热下注证。癃闭舒胶囊（B错）【主治】肾气不足、湿热瘀阻所致的癃闭，症见腰膝酸软、尿频、尿急、尿痛、尿线细，伴小腹拘急疼痛；前列腺增生症见上述证候者。八正合剂（D错）【主治】湿热下注所致的淋证，症见小便短赤、淋沥涩痛、口燥咽干等。肾炎四味片（E错）【主治】湿热内蕴兼气虚所致的水肿，症见浮肿、腰痛、乏力、小便不利；慢性肾炎见上述证候者。